粉尘在呼吸道的沉积方式有多种，但没有下列哪项
A. 撞击
B. 沉降
C. 巨噬细胞吞噬
D. 弥散作用
E. 被气道上皮细胞及分泌物截留

正确答案：C。巨噬细胞吞噬

解析：本题考查的是粉尘在呼吸道的沉积方式。粉尘粒子随气流进入呼吸道后，主要通过撞击（A对）、截留（E对）、重力沉积、静电沉积、布朗运动（D对）而发生沉降（B对）。粒径较大的尘粒在大气道分岔处可发生撞击沉降；纤维状粉尘主要通过截留作用沉积。巨噬细胞吞噬作用（C错，为本题正确答案）是人体对粉尘的防御和清除。